患者，女，28岁。产后乳房胀痛，位于乳房外上方皮肤焮红，肿块形似鸡卵，压痛明显，按之中软，有波动感，伴壮热口渴。切开引流的部位及切口是
A. 循乳络方向作放射状切口
B. 乳晕旁弧形切口
C. 脓处作任意切口
D. 以乳头为中心的弧形切口
E. 脓肿波动明显处作切口

正确答案：A。循乳络方向作放射状切口

解析：该患者符合乳痈的特点：乳房局部结块，红肿热痛，伴有恶寒发热等全身症状。乳痈是由热毒入侵乳房而引起的急性化脓性疾病。相当于西医的急性化脓性乳腺炎。成脓期以切开排脓为主，切口应按乳络方向并与脓腔基底大小一致，因为乳腺每一腺叶有单独的腺管，呈放射状聚向乳头，并分别开口于乳头，故应循乳络方向作放射状切口（A对）。乳晕旁弧形切口会损害乳络，形成乳漏（B错）。脓处作任意切口，可能会损伤乳络形成乳漏、或导致引流不通畅而形成袋脓等（C错）。以乳头为中心的弧形切口同样会损害乳络（D错）。脓肿波动明显处作切口可能使引流通畅而不致形成袋脓，切口位置应选择脓肿稍低的部位（E错）。